孕早期是指
A. 孕8周以前
B. 孕12周以前
C. 孕12周以后
D. 孕16周以内
E. 孕20周以内

正确答案：B。孕12周以前

解析：本题考查孕早期的定义。孕早期是指从妊娠开始到妊娠12+6（B对ACDE错）周前，这是胎儿各器官发育形成的重要时期。